错误的是
A. 颅后窝
B. 延髓和脑桥的背侧
C. 小脑幕的下方
D. 间脑的上方
E. 无

正确答案：D。间脑的上方

解析：小脑位于颅后窝（A对），借其上、中、下三对小脑脚连于脑干的背面（B对）。小脑上方借大脑横裂和小脑幕（C对）与大脑分隔。间脑位于中脑和端脑之间，因而间脑位置比脑干高，故小脑位于间脑的下方（D错，为本题正确答案）。